标准米面中含量相对精白米面高的营养成分是
A. 维生素B₁
B. 维生素B₂
C. 维生素A
D. 烟酸
E. 硒

正确答案：A。维生素B₁